浸润型肺结核不常发生的部位是
A. 肺底
B. 肺上叶后段
C. 肺尖
D. 锁骨下区
E. 背段

正确答案：A。肺底

解析：浸润型肺结核：多在肺上叶尖段、后段（B对）及下叶背段，故浸润型肺结核不常发生的部位是肺底（A错，为本题正确答案）。